运动员禁用的兴奋剂包括
A. 麻黄碱
B. 甲睾酮
C. 呋塞米
D. 奥美拉唑
E. 普萘洛尔

正确答案：A、B、C、E。麻黄碱；甲睾酮；呋塞米；普萘洛尔

解析：本题考查兴奋剂。兴奋剂的分类：1.刺激剂：①精神刺激药：包括苯丙胺和它的相关衍生物及其盐类。②拟交感神经胺类药物：以麻黄碱（A对）和它们的衍生物及其盐类为代表。③咖啡因类：此类又称为黄嘌呤类，因其带有黄嘌呤基团。④杂类中枢神经刺激物质：如胺苯唑、戊四唑、尼可刹米和士的宁等。2.麻醉止痛剂：①哌替啶类：杜冷丁、二苯哌己酮和美沙酮，以及它们的盐类和衍生物，其主要功能性化学基团是哌替啶。②阿片生物碱类：包括吗啡、可待因、乙基吗啡（狄奥宁）、海洛因、喷他佐辛（镇痛新），以及它们的盐类和衍生物，化学核心基团是从阿片中提取出来的吗啡生物碱。3.蛋白同化制剂（合成类固醇）又称同化激素，俗称合成类固醇，是合成代谢类药物，具有促进蛋白质合成和减少氨基酸分解的特征，可促进肌肉增生，提高动作力度和增强男性的性特征，如甲睾酮（B对）。4.肽类激素及类似物包括：①人生长激素（HGH）及其类似物；②红细胞生成素（EPO）及其类似物；③胰岛素、胰岛素样生长因子及其类似物；④促性腺激素；⑤促皮质素类。5.利尿剂，如呋塞米（C对）。6.β受体阻滞剂，如普萘洛尔（E对）。奥美拉唑（D错）为质子泵抑制剂，用于消化性溃疡的治疗，不属于兴奋剂。